冷脓肿可出现于
A. 口底多间隙感染
B. 结核性淋巴结炎
C. 化脓性淋巴结炎
D. 腐败坏死性蜂窝组织炎
E. 化脓性下颌下腺炎

正确答案：B。结核性淋巴结炎

解析：骨结核病变炎症波及周围组织时，淋巴结可彼此粘连成团，或与皮肤粘连。皮肤表面无红、热及明显压痛，扪之有波动感。此种液化现象称为冷脓肿。掌握“面颈部淋巴结炎”知识点。